关于胃肠内在神经丛的叙述，正确的是
A. 包括黏膜下神经丛和肌间神经丛
B. 含大量神经纤维，但神经元不多
C. 递质仅是乙酰胆碱或去甲肾上腺素
D. 仅有运动功能，而无感觉功能
E. 不受外来自主神经系统的控制

正确答案：A。包括黏膜下神经丛和肌间神经丛